短暂性脑缺血发作（TIA），出现相应的症状及体征，完全恢复最长应在
A. 6小时内
B. 12小时内
C. 24小时内
D. 48小时内
E. 72小时内

正确答案：C。24小时内

解析：短暂性脑缺血发作（TIA）是颈动脉或椎-基底动脉系统发生短暂性血液供应不足，引起局灶性脑缺血导致突发的、短暂性、可逆性神经功能障碍。发病无先兆，一般无意识障碍，可反复发作，每次持续数分钟，通常在30分钟内完全恢复，超过2小时常遗留轻微神经功能缺损表现或CT及MRI显示脑组织缺血征象，但一般在24小时内（C对）完全恢复，且无后遗症。